属于二次污染物的是
A. SO₂
B. CO
C. H₂S
D. PAH
E. PAN

正确答案：E。PAN

解析：本题考查二次污染物。二次污染物是指排入大气的污染物在物理、化学等因素的作用下发生变化，或与环境中的其他物质发生反应所形成的理化性质不同于一次污染物的新的污染物。如汽车尾气中的氮氧化物（NOₓ）和挥发性有机物在日光紫外线的照射下，经过一系列的光化学反应生成的臭氧、醛类以及各种过氧酰基硝酸酯（PANs）（E对ABCD错）。